人工喂养较母乳喂养更易发生佝偻病最主要的原因是
A. 食物中含磷低
B. 食物中含钙低
C. 钙磷比例不当
D. 维生素D含量少
E. 日光照射不足

正确答案：C。钙磷比例不当

解析：食物中钙、磷含量过低或比例不当：食物中钙磷比例直接影响钙、磷的吸收，母乳钙磷比例适宜（2:1），钙的吸收率较高；而牛乳钙磷含量虽高于人乳，但钙磷比例不当（1.2:1），钙的吸收率较低，故人工喂养者更易发生佝偻病。掌握“维生素D缺乏性佝偻病”知识点。